最有助于诊断风湿性心脏瓣膜病二尖瓣狭窄的体征是
A. Graham-Steel杂音
B. 面颊部呈紫红色
C. 心浊音界呈梨形
D. 第二心音亢进
E. 心尖部舒张期隆隆样杂音

正确答案：E。心尖部舒张期隆隆样杂音

解析：最有助于风湿性心脏瓣膜病二尖瓣狭窄的体征是是心尖部舒张期隆隆样杂音，此为二狭的特征性体征（E对）。Graham-steel杂音（A错），即肺动脉瓣舒张期杂音，由肺动脉扩张引起的相对性关闭不全所致。面颊部呈紫红色（B错）对二尖瓣狭窄具有一定的诊断意义，但是特异性、敏感性均低于心尖区隆隆样杂音。梨形心（C错）指肺动脉段凸出及心尖上翘，主动脉结节缩小或正常，心脏状如梨形。多见于右心负荷或以其为主的心腔变化。常见疾病有二尖瓣病变、肺动脉瓣狭窄、肺动脉高压和肺心病等；第二心音亢进（D错）可见于二尖瓣狭窄伴肺动脉高压、高血压、室间隔缺损等，两者对风湿性心脏瓣膜病二尖瓣狭窄的诊断特异性都不及特征性心脏杂音。